败血症的常见热型是
A. 稽留热
B. 弛张热
C. 间歇热
D. 回归热
E. 不规则热

正确答案：B。弛张热

解析：败血症常见的热型是弛张热（B对）。稽留热常见于大叶性肺炎、斑疹伤寒及伤寒高热期（A错）。间歇热常见于疟疾、急性肾盂肾炎等（C错）。回归热常见于回归热、霍奇金病等（D错）。不规则热常见于结核病、风湿热、支气管肺炎、渗出性胸膜炎等（E错）。